患者头痛而晕，心悸不宁，神疲乏力，面色无华，舌淡苔薄白，脉细弱。治疗应首选
A. 半夏白术天麻汤
B. 加味四物汤
C. 大定风珠
D. 大补元煎
E. 六君子汤

正确答案：B。加味四物汤

解析：由于血分不足，虚火上逆，故头痛而晕；血不足则心神失养，故心悸不宁；血虚易导致气虚，则神疲乏力；面色无华，舌淡苔薄白，脉细弱，均为血虚之象。故辩证为头痛血虚头痛，治宜养血滋阴，和络止痛，方选加味四物汤（B对）。半夏白术天麻汤功能燥湿化痰，平肝息风，为治疗头痛痰浊头痛的选方（A错）。大定风珠功能增液滋阴息风，为治疗颤证髓海不足证的选方（C错）。大补元煎功能救本培元，大补气血，为月经后期血虚证的选方（D错）。六君子汤功能补脾化痰，为治疗哮证缓解期之肺脾气虚证选方（E错）